低氧血症
A. SB升高
B. AB升高
C. 两者均升高
D. 两者均不升高
E. 无

正确答案：D。两者均不升高

解析：低氧血症使细胞内糖的无氧酵解增强而引起乳酸增加发生代谢性酸中毒，导致HC03-为了缓冲乳酸而减少，所以AB和SB均降低（AB错，故D为本题正确答案）。。